细菌性痢疾病变多位于
A. 直肠和乙状结肠
B. 空肠
C. 十二指肠
D. 回肠
E. 以上都不是

正确答案：A。直肠和乙状结肠

解析：细菌性痢疾病变多位于直肠和乙状结肠（A对）。回肠末端是肠伤寒（P358）的好发部位；回盲部是肠结核（P356）的好发部位（D错）。十二指肠（C错）易发生溃疡。